润湿剂约占牙膏含量的
A. 1%～2%
B. 2%～4%
C. 20%～40%
D. 20%～60%
E. 0.1%～0.5%

正确答案：C。20%～40%

解析：润湿剂占20%～40%。其作用是保持湿润，防止接触空气而硬化，并使剂型保持稳定，常用的有甘油（丙三醇），聚乙二醇和山梨醇，这些制剂需要防腐，以便阻止微生物生长。掌握“自我口腔保健方法”知识点。